可确诊反流性食管炎的依据是
A. 食管测压异常
B. 胃镜发现食管下段黏膜破损
C. 食管酸监测异常
D. 反酸烧心症状
E. ¹³C尿素呼气试验阳性

正确答案：B。胃镜发现食管下段黏膜破损

解析：胃镜是诊断反流性食管炎（RE）最准确的方法，并能判断反流性食管炎的严重程度和有无并发症，结合活检可与其他原因引起的食管炎和其他食管病变（如食管癌等）作鉴别。胃镜发现食管下段黏膜破损是可确诊反流性食管炎的依据（B对）。食管测压异常、食管酸监测异常均有助于反流性食管炎的诊断，但不作为确诊依据（AC错）。反酸烧心症状是反流性食管炎最常见的典型症状，但不能确诊本病（D错）。13C尿素呼气试验阳性提示幽门螺杆菌感染（E错）。